突变的后果有
A. 肿瘤，显性致死，炎症
B. 显性致死，隐性致死，遗传性疾病
C. 显性致死，炎症，遗传性疾病
D. 隐性致死，变态反应，肿瘤

正确答案：B。显性致死，隐性致死，遗传性疾病

解析：本题考查突变的后果。突变发生在生殖细胞，其后果可能有显性致死，隐性致死，遗传性疾病（B对ACD错）。